下列哪项不是黄体功能不全、肝郁血热证的临床表现
A. 月经周期或先或后
B. 经量或多或少
C. 经色紫红、质稠、有块
D. 经血排出不畅
E. 胸闷胁胀

正确答案：A。月经周期或先或后

解析：黄体功能不全时，月经周期缩短，月经提前（A错，为本题的正确答案）。肝郁血热证由于忿怒抑郁，经血失约，故经量或多或少（B对）；肝郁化火，火热内盛，热扰冲任，经血色深红或紫红，质稠有块（C对）、经行不畅（D对），肝气郁滞胁肋，则乳房或少腹胀痛，胸胁胀满（E对）。